经产妇，妊娠37周，无原因出现无痛性阴道出血，经卧床休息，给予镇静剂未见明显好转，阴道仍有活动性出血，初步诊断为前置胎盘，为了决定分娩方式，拟确定前置胎盘类型，应进行
A. 输液配血行肛门检查
B. 输液配血行阴道检查
C. 超声胎盘定位检查
D. X线软组织检查
E. 放射性核素扫描法

正确答案：C。超声胎盘定位检查

解析：在前置胎盘时，是禁止肛查和阴道检查的，因为可以加重出血。这两个答案需在不是前置胎盘的病例中应用。前置胎盘是根据胎盘下缘与宫颈内口的关系分类的。超声可清楚显示子宫壁、胎盘、胎先露部及宫颈的位置，根据胎盘下缘与宫颈内口的关系确定前置胎盘的类型。掌握“前置胎盘”知识点。